患者胃肠热盛，大便秘结，腹满硬痛而拒按，潮热，神昏谵语，但又兼见面色苍白，四肢厥冷，精神萎顿。其病机是
A. 虚中夹实
B. 真实假虚
C. 由实转虚
D. 真虚假实
E. 实中夹虚

正确答案：B。真实假虚

解析：真实假虚，是指本质为实证，反见某些虚赢现象的证候。其病机是由于热结肠胃、痰湿壅积、湿热内蕴、瘀血停蓄等，邪气大积大聚，以致经脉阻滞，气血不能畅达，因而表现出一些类似虚证的假象。肠热腑实证，是指里热炽盛，腑气不通，以发热、大便秘结、腹满硬痛为主要表现的实热证候。面色苍白，四肢厥冷，精神萎顿，均多因阳气虚衰所致的虚寒证候。肠热腑实证候不兼见面色苍白，四肢厥冷，精神萎顿。故其病机为真实假虚（B对）。虚中夹实的特点是正虚为主，邪实为次（A错）。由实转虚指原先表现为实证，后来表现为虚证（C错）。真虚假实指本质为虚证，反见某些盛实现象的证候（D错）。实中夹虚的特点是邪实为主，正虚为次（E错）。